“密封发酵法”进行粪便无害化处理时，杀死病原菌与寄生虫卵的主要因素时
A. 高温
B. 缺氧
C. 氨气
D. 缺乏营养物质
E. 生物拮抗作用

正确答案：C。氨气

解析：本题考查密封发酵法。密封发酵法是一种常用的粪便无害化处理方法，其主要原理是通过密封发酵的方式，在缺氧的环境中，利用氨气（C对ABDE错）来杀死病原菌和寄生虫卵。